不耐酸，食物或碱性食物可减少其吸收
A. 红霉素
B. 罗红霉素
C. 克拉霉素
D. 克林霉素
E. 四环素

正确答案：A。红霉素